正确描述喙肩弓的是
A. 连于肩胛骨的喙突与肩峰之间
B. 位于肩关节前方
C. 防止肩关节向上脱位
D. 由纤维软骨构成
E. 由喙肩韧带、喙锁韧带、喙肱韧带共同构成

正确答案：C。防止肩关节向上脱位

解析：喙肩弓是由喙肩韧带、喙突、肩峰共同组成的（E错），所以不能说它仅仅是由纤维软骨组成的（D错），也不能说它就连于肩胛骨的喙突与肩峰之间（A错），连于肩胛骨的喙突与肩峰之间的是喙间韧带，是喙肩弓的一部分。喙肩弓位于肩关节上方（B错），防止肩关节向上脱位（C对）。